医学伦理学的行善原则不包括
A. 努力使患者受益
B. 关心患者的客观利益和主观利益
C. 选择受益最大，伤害最小的行动方案
D. 努力预防或减少难以避免的伤害
E. 把患者的利益看得高于一切

正确答案：B。关心患者的客观利益和主观利益

解析：医学伦理学的行善原则不包括关心患者的客观利益和主观利益。行善原则是医学伦理学的根本规范、最高原则。所谓行善原则，就是要求医学界的医学行为符合善的医学道德目的。行善原则是医学道德的总原则，医学道德目的，即医学道德终极标准。两者既相互联系，又存在相互区别。行善原则调整的是整个医学界医学行为引起的一切伦理关系，它是医学伦理学总的根本的道德原则（B错，为本题正确答案）。